对于切除阑尾的术后病人，宜采取的医患模式是
A. 主动-被动型
B. 被动-主动型
C. 指导合作型
D. 共同参与型
E. 合作-指导型

正确答案：C。指导合作型

解析：1956年，美国学者萨斯与荷伦德发表了《医患关系的基本模式》一文，指出病人症状的严重程度是影响医师与病人各自主动性大小的重要因素，依此将医患关系归纳为三种类型：主动-被动型、指导-合作型、共同参与型（BE错）。指导-合作型（C对）是指在医疗活动中，医患双方具有一定的主动性，但仍以医务人员为主，适合于急性感染期病人（如切除阑尾的术后病人）。主动-被动型（A错）指医师主动命令，病人被动服从，适合难以表述自己主观意见的病人，如麻醉、严重外伤昏迷的病人等。共同参与型（D错）指医患双方共同制定并实施诊断方案，适合慢性疾病病人和心理疾病病人。